男，70岁。腹部绞痛伴腹胀4小时，无呕吐。下消化道X线钡剂造影见直肠上段钡剂受阻，钡影尖端呈“鸟嘴”形。最可能的诊断是
A. 肠套叠
B. 乙状结肠癌
C. 乙状结肠扭转
D. 直肠癌
E. 小肠扭转

正确答案：C。乙状结肠扭转

解析：老年男性患者，腹部绞痛、腹胀，X线钡剂造影可见直肠上段钡剂受阻，钡影尖端呈“鸟嘴”形（提示乙状结肠扭转），结合患者病史和影像学表现，最可能的诊断是乙状结肠扭转（C对）。乙状结肠扭转多见于老年人，主要表现为腹部持续性胀痛，腹部X线平片可见马蹄状巨大的双腔充气肠袢，圆顶向上；钡剂灌肠X线检查见扭转部位钡剂受阻，钡影尖端呈“鸟嘴”形。肠套叠（P364）（A错）多见于小儿，典型表现为腹痛、血便和腹部包块，钡剂灌肠X线检查见钡剂在结肠受阻，阻端钡影呈“杯口”状，甚至呈“弹簧状”阴影。乙状结肠癌（P387）（B错）以肠梗阻、便秘、腹泻、便血等为主要表现，早期钡剂灌肠X线检查表现为黏膜紊乱、中断、肠壁僵硬等，晚期可见肠腔一侧充盈缺损或肠管腔内龛影或环状狭窄。直肠癌（P390）（D错）早期无明显症状，随着病变进展，患者可出现便频、里急后重、排便不尽感等直肠刺激症状以及便细、大便表面带血及黏液等症状。小肠扭转（E错）主要表现为突发的持续性腹部剧痛、频繁呕吐等，腹部X线平片可见扩张的肠袢，肠腔内有多个液气平，钡剂灌肠不能显影。